用作栓剂水溶性基质的是
A. 可可豆脂
B. 甘油明胶
C. 椰油酯
D. 棕榈酸酯
E. 混和脂肪酸酯

正确答案：B。甘油明胶

解析：本题考查栓剂的基质。甘油明胶（B对）为水溶性基质；可可豆脂（A错）、椰油酯（C错）、棕榈酸酯（D错）和混和脂肪酸酯（E错）皆为油脂性基质。